经产妇，妊娠35周，今晨出现无原因，无痛性阴道流血。为明确诊断，需做检查项目是
A. 阴道检查
B. 肛门检查
C. 血小板计数
D. B型超声检查
E. 凝血功能检查

正确答案：D。B型超声检查

解析：经产妇（多孕产次为前置胎盘的好发人群），妊娠35周(妊娠晚期），出现无原因，无痛性阴道流血（前置胎盘的典型症状为无诱因、无痛性反复阴道流血）。综合该患者的病史、临床表现，该患者首先考虑的诊断是前置胎盘。因为B型超声检查可清楚显示子宫壁、胎盘、胎先露部及宫颈的位置，并根据胎盘下缘与宫颈内口的关系，确定前置胎盘类型，所以为明确诊断，需做检查项目是B型超声检查（D对）。